一般来说，有害气体的着陆点距烟囱的距离是有效排出高度的
A. 3～5倍
B. 6～8倍
C. 9～10倍
D. 10～20倍
E. ＞20倍

正确答案：D。10～20倍

解析：本题考查有害气体的着陆点距烟囱的距离。一般来说，有害气体的着陆点距烟囱的距离是有效排出高度的10～20倍（D对ABCE错）。